属于斜线式的是
A. 缺失右下478，左下78
B. 缺失右下12458，左下1268
C. 缺失右下125678，左下124578
D. 缺失右下128，左下1356
E. 缺失右下1245，左下12

正确答案：C。缺失右下125678，左下124578

解析：本题考查可摘局部义齿的Cummer分类。属于斜线式的是缺失右下125678，左下124578（C对）。可摘局部义齿的Cummer分类：第一类：支点线斜割牙弓，即斜线式。第二类：支点线横割牙弓，即横线式。第三类：支点线位于牙弓的一侧而呈前后方向者，即纵线式。第四类：支点线构成多边形，即平面式。